参照药品管理要求进行管理，应经国家食品药品监督管理总局注册的是
A. 首次进口的属于补充维生素、矿物质的保健食品
B. 特殊医学配方食品
C. 体外诊断试剂
D. 使用保健食品原料目录的原料生产的保健食品

正确答案：B。特殊医学配方食品

解析：本题考查特殊医学用途配方食品和婴幼儿配方食品的管理。参照药品管理要求进行管理，应经国家食品药品监督管理总局注册的是特殊医学配方食品（B对）。特殊医学用途配方食品，是指为了满足进食受限、消化吸收障碍、代谢紊乱或特定疾病状态人群对营养素或膳食的特殊需要，专门加工配制而成的配方食品，包括适用于1岁以上人群的特殊医学用途配方食品和适用于0月龄至12月龄的特殊医学用途婴儿配方食品。《食品安全法》将特殊医学用途配方食品参照药品管理的要求予以对待，规定该类食品应当经国家市场监督管理部门注册。医疗器械，是指直接或者间接用于人体的仪器、设备、器具、体外诊断试剂及校准物、材料以及其他类似或者相关的物品，包括所需要的计算机软件。目前国家对体外诊断试剂（C错）的注册管理分为两类，其中用于血源筛查和采用放射性核素标记的体外诊断试剂按照药品进行管理，其他体外诊断试剂均按照医疗器械进行管理。保健食品，是指声称具有特定保健功能或者以补充维生素、矿物质为目的的食品。即适宜于特定人群食用，具有调节机体功能，不以治疗疾病为目的，并且对人体不产生任何急性、亚急性或者慢性危害的食品。使用保健食品原料目录以外原料的保健食品（D错）和首次进口的保健食品应当经国务院食品安全监督管理部门注册。首次进口的保健食品中属于补充维生素、矿物质等营养物质的（A错），应当报国务院食品安全监督管理部门备案。其他保健食品应当报省、自治区、直辖市人民政府食品安全监督管理部门备案。进口的保健食品应当是出口国（地区）主管部门准许上市销售的产品。